儿少卫生学的研究对象是
A. 从出生后的婴儿到发育成熟的青年
B. 中小学生群体
C. 大学生群体
D. 0~3岁婴幼儿群体
E. 学龄前儿童

正确答案：A。从出生后的婴儿到发育成熟的青年

解析：儿童少年卫生学研究的对象是从出生前期到青年期之间的问题，重点是中小学生群体。